40岁以上筛查结肠癌首选
A. 结肠镜
B. 腹部CT
C. 粪潜血
D. 腹部B超
E. 腹部MRI

正确答案：C。粪潜血

解析：结肠癌是胃肠道中常见的恶性肿瘤，粪潜血检查（C对）用于40岁以上人群的早期筛查；面对高危人群的结直肠癌，推荐行结肠镜检查（A错），镜下发现病灶取病理活检可明确诊断；超声（D错）和CT检查（B错）对了解腹部肿块和肿大淋巴结及肝内有无转移等均有帮助；腹部MRI（E错）一般不用于结肠癌的检查。